下列哪个选项不是微量元素
A. 铁
B. 碘
C. 镁
D. 锌
E. 铜

正确答案：C。镁

解析：微量元素是指人体每日需要量在100mg以下的化学元素，主要包括铁（A对）、碘（B对）、铜（E对）、锌（D对）、锰、硒、氟、钼、钴、铬等。成人每天参考摄入镁（C错，为本题正确答案）350mg，不是微量元素。